以下关于菌斑指数（PLI）的叙述中，不正确的是
A. 根据菌斑覆盖面积记分
B. 用视诊结合探针的方法检查
C. 可检查选定的几颗牙
D. 每颗牙检查4个牙面
E. 用于评价口腔卫生状况和衡量牙周病防治效果

正确答案：A。根据菌斑覆盖面积记分

解析：菌斑指数（PLI）根据牙面菌斑的厚度记分而不根据菌斑覆盖面积记分。用于评价口腔卫生状况和衡量牙周病防治效果。用视诊结合探针的方法检查，检查时用探针轻划牙面，根据菌斑的量和厚度记分。菌斑指数可检查全口牙面，也可检查选定的几颗牙。每颗牙检查4个牙面，即近中颊面、正中颊面、远中颊面以及舌面。每颗牙的记分为4个牙面记分之和除以4，个人记分为每颗牙记分之和除以受检牙数。掌握“牙周病流行病学及分级预防”知识点。